顿咳得表现是
A. 阵发性痉挛性咳嗽，咳毕有鸡鸣样呼气性回声，日轻夜重
B. 咳嗽、发热、流涕经表证解后，咳嗽渐止
C. 咳无定时，夜间较多，喉间痰鸣
D. 突发阵发性痉咳，有异物吸入史
E. 发热，咳嗽，痰壅，气急鼻扇

正确答案：A。阵发性痉挛性咳嗽，咳毕有鸡鸣样呼气性回声，日轻夜重

解析：顿咳的表现为咳呈阵发，连续不断，咳止时常有鸡鸣样回声，因其病程较长，缠绵难愈，又称“百日咳”多因风邪与痰热搏结所致，常见于小儿，其鸡鸣样回声是辨别重点（A对）。